关于稳定性试验的表述，正确的是
A. 制剂必须进行加速试验和长期试验
B. 原料药只需进行影响因素试验和长期试验
C. 为避免浪费，稳定性试验的样品应尽可能少量生产
D. 长期试验的温度是60°C，相对湿度是75%
E. 影响因素试验、加速试验和长期试验均只需一批供试品

正确答案：A。制剂必须进行加速试验和长期试验

解析：本题考查药物稳定性试验方法。关于稳定性试验的表述，正确的是制剂必须进行加速试验和长期试验（A对）。稳定性试验包括影响因素试验、加速试验与长期试验。影响因素试验为原料药必须进行的试验，制剂则必须进行加速试验和长期试验（A对）。原料药不仅需进行影响因素试验和长期试验，也应进行加速试验（B错）。稳定性试验的样品应是一定规模生产的，供试品量相当于制剂稳定性试验所要求的批量，原料合成工艺路线、方法、步骤应与大生产一致（C错）。长期试验是在接近药品的实际贮存条件下（温度25±2℃、相对湿度60±10%）放置12个月，其目的是为制订药物的有效期提供依据（D错）。影响因素试验用一批原料药进行；加速实验与长期试验适用于原料药与药物制剂，要求用3批供试品进行（E错）。